前额连眉棱骨痛属于
A. 太阳经
B. 少阳经
C. 阳明经
D. 少阴经
E. 厥阴经

正确答案：C。阳明经

解析：阳明经与任脉行于头前，故前额连眉棱骨痛者，病在阳明经（C对）。太阳经与督脉行于头后，故后头连项痛者，病在太阳经（A错）。少阳经起于目外目眦，上抵头角，行于头侧部，故头两侧痛者，病在少阳经（B错）。少阴头痛，部位不一定，有的全头痛，有的头痛连齿（D错）。足厥阴肝经系目系，与督脉络于颠，行于颠顶部，故颠顶痛者，病在厥阴经（E错）。